患者，女，26岁，已婚。人流术后1周，高热恶寒，口苦咽干，精神不振，下腹疼痛拒按，带下赤白臭秽，小便黄赤，大便秘结，舌红苔黄糙，脉滑数。检查体温39℃，脉搏110次/分，白细胞计数19、6×109/L，其诊断是
A. 急性盆腔炎，热毒壅盛证
B. 急性盆腔炎，气滞血瘀证
C. 慢性盆腔炎，阴虚血热证
D. 慢性盆腔炎，湿热壅阻证
E. 慢性盆腔炎，气滞血瘀证

正确答案：A。急性盆腔炎，热毒壅盛证

解析：高热腹痛拒按是因为热毒内侵，于冲任胞宫气血相搏结，邪正交争，营卫不和。热毒损伤任脉带脉，则带下赤白臭秽。小便黄赤，大便秘结，舌红苔黄糙，脉滑数均为热盛之征（A对）。盆腔炎气滞血瘀证多为慢性盆腔炎（B错）。慢性盆腔炎阴虚血热证多伴有手足心热，两颧潮红，烦躁等症状（C错）。慢性盆腔炎湿热壅阻证主要证候：少腹部隐痛，低热起伏经行或劳累时加重，带下量多，色黄，质黏稠，并伴有胸闷纳呆，口干不欲饮大便溏或秘结，小便黄赤等湿热之征（D错）。慢性盆腔炎气滞血瘀证主要证候：少腹部刺痛或胀痛，经行腹痛疼痛加重，经血量多有块，并伴有经前情志抑郁，乳房胀痛；舌体紫黯，有瘀斑、瘀点等气滞血瘀之征（E错）。